对于牙齿龋病的预防，儿童时期的窝沟封闭能够起到非常好的效果。关于窝沟封闭的年龄限制，以下说法正确的是
A. 一般为牙齿萌出后4年内可以进行
B. 乳磨牙一般5～6岁左右进行
C. 第一恒磨牙在8岁左右进行
D. 第二恒磨牙在10岁左右进行
E. 乳磨牙在7岁左右进行

正确答案：A。一般为牙齿萌出后4年内可以进行

解析：本题考查窝沟封闭。对于牙齿龋病的预防，儿童时期的窝沟封闭能够起到非常好的效果。关于窝沟封闭的年龄限制，以下说法正确的是一般为牙齿萌出后4年内可以进行（A对）。封闭时机以磨牙萌出后达到咬合平面最为合适。一般乳磨牙在3～4岁（BE错），第一恒磨牙在6～7岁（B错），第二恒磨牙在11～13岁为最适宜封闭的年龄（D错）。牙釉质发育不全，（牙合）面有充填物但存在未做封闭的窝沟，可根据具体情况决定是否做封闭。总之，封闭的最佳时机是牙齿完全萌出，龋尚未发生的时候。